易失气味的饮片是
A. 火麻仁
B. 麻黄
C. 丁香
D. 大枣
E. 甘草

正确答案：C。丁香

解析：本题考查的是中药饮片分类。易失气味的饮片是丁香（C对）。易失去气味饮片包括：广藿香、香薷、紫苏、薄荷、佩兰、荆芥、细辛、肉桂、花椒、月季花、玫瑰花、吴茱萸、八角茴香、丁香、檀香、沉香、厚朴、独活、当归、川芎。易泛油饮片包括：独活、火麻仁（A错）、核桃仁、榧子、千金子、当归、牛膝、巴豆、狗肾、木香、龙眼肉、橘核、苦杏仁、蝼蛄、前胡、川芎、白术、苍术。易变色饮片包括：月季花、白梅花、玫瑰花、款冬花、红花、山茶花、金银花、扁豆花、橘络、佛手、通草、麻黄（B错）。易发霉饮片包括：天冬、牛膝、独活、玉竹、黄精、白果、橘络、全瓜蒌、山茱萸、莲子心、枸杞子、大枣（D错）、马齿苋、大蓟、小蓟、大青叶、桑叶、哈蟆油、鹿筋、狗肾、水獭肝、蛤蚧、黄柏、白鲜皮、甘草（E错）、葛根等。